阴盛格阳应采用的治法是
A. 以寒治热
B. 以热治热
C. 以热治寒
D. 以寒治寒
E. 用热远热

正确答案：B。以热治热

解析：本题考查的是反治。阴盛格阳应采用的治法是以热治热（B对）。热因热用：热因热用又称“以热治热”，是指针对假热的临床表现，用热性药物来进行治疗。适用于阴寒内盛、格阳于外，反见假热之象的真寒假热证。以寒治热（A错）即热者寒之。热者寒之：热者寒之又称“以寒治热”，是指热性病证出现热象，用寒凉方药进行治疗。如表热证用辛凉解表方药，里热证用苦寒清里方药治疗等。以热治寒（C错）即寒者热之。寒者热之：寒者热之又称“以热治寒”，是指寒性病证出现寒象，用温热方药进行治疗。如表寒证用辛温解表方药，里寒证用辛热温里方药等。以寒治寒（D错）即寒因寒用。寒因寒用：寒因寒用又称“以寒治寒”，是指针对假寒的临床表现，用寒性药物进行治疗。适用于里热盛极、阳盛格阴，反见假寒之象的真热假寒证。用热远热（E错）属于因时制宜。用热远热：夏季，气候炎热，人体腠理疏松，阳气偏盛，应避免过用热性药物，以免耗伤气阴。